女，28岁，结婚3年未孕，月经规律，妇科检查；子宫正常大，双侧附件正常。男方精液检查正常。经检查诊断为黄体发育不良，最恰当的内分泌治疗是
A. 雌激素治疗
B. 排卵后黄体酮治疗
C. 人工周期
D. 少量肾上腺皮质激素
E. 口服溴隐亭

正确答案：B。排卵后黄体酮治疗

解析：黄体发育不良者体内孕激素水平偏低。黄体发育不全的治疗最常用的方法是补充体内孕酮的不足，一般在排卵后给与黄体酮（孕激素）治疗（B对）。雌激素治疗（P347）（A错）适用于无排卵性功能失调性子宫出血患者急性大量出血，雌激素可促进子宫内膜增生，可能加重患者病情。人工周期（雌孕激素序贯疗法）（P348）（C错）主要用于无排卵性功能失调性子宫出血的治疗。肾上腺皮质激素（D错）对黄体发育不良无治疗作用。溴隐亭（P351）（E错）主要用于黄体功能不足合并高催乳素血症的治疗。